足三阴经从起始部至内踝上8寸以下的分布是
A. 厥阴在前，太阴在中，少阴在后
B. 厥阴在前，少阴在中，太阴在后
C. 少阴在前，太阴在中，厥阴在后
D. 太阴在前，厥阴在中，少阴在后
E. 太阴在前，少阴在中，厥阴在后

正确答案：A。厥阴在前，太阴在中，少阴在后

解析：该题考查十二经脉的分布规律，属记忆内容。足三阴经在足内踝上8寸以下为厥阴在前、太阴在中、少阴在后，至内踝上8寸以上，太阴经交出厥阴之前（A对BCDE错）。